与水湿痰饮形成关系密切的因素是
A. 脾肝肾功能障碍
B. 肝肾心功能障碍
C. 肺脾肾功能障碍
D. 心肺脾功能障碍
E. 肺脾肝功能障碍

正确答案：C。肺脾肾功能障碍

解析：本题考察痰饮的形成。肺主宣发肃降，为水之上源，如肺失宜降，水道不利，津液输布失司，则聚水而生痰饮；脾主运化水液，为制水之脏，脾失健运，水湿内生，可以凝聚生痰；肾主水，肾阳不足，水液不得蒸化，也可停而化生痰饮；肝主疏泄，主调畅一身气机，若肝失疏泄，气机郁滞，津液停积可为痰为饮；三焦为决渎之官，是水液运行的通道，若水道不利，津液失布，亦能聚水生痰。因此，痰饮的形成多与肺、脾、肾、肝及三焦的功能失常密切相关，其中关系最密切的当属肺脾肾功能障碍（C对）。